佝偻病轻度“O”型腿标准是两足跟靠拢，膝关节间距小于
A. 2cm
B. 3cm
C. 3～6cm
D. 3～4cm
E. 6cm

正确答案：B。3cm

解析：本题考查维生素D缺乏性佝偻病“O”型腿的相关内容。膝外翻“O”型腿标准：取双下肢并拢，自然站立位。正常标准：双膝间距及双踝间距为0cm，双胫骨间距（生理弯曲度）应该不大于2cm。轻度“O”型腿标准是两足跟靠拢，膝关节间距小于3cm（B对ACDE错），3～6cm为中度，6cm以上为重度。